根据《基本医疗保险用药管理暂行办法》和《2020年国家医保药品目录调整工作方案》，关于医保药品目录制定与调整的说法，正确的是
A. 医保目录调入分为常规准入和谈判准入两种方式，价格较高或者对医疗保险基金影响较大的专利独家应当通过谈判方式准入
B. 统筹地区医疗保障主管部门建立完善医保药品目录动态调整机制，原则上每年调整一次
C. 拟纳入《基本医疗保险药品目录》的化学药，可以由药品上市许可持有人按程序申报或者由临床专家按程序推荐，审核通过后调入医保药品目录
D. 含国家珍贵、濒危野生动植物药材的药品根据需要可申请调入医保药品目录

正确答案：A。医保目录调入分为常规准入和谈判准入两种方式，价格较高或者对医疗保险基金影响较大的专利独家应当通过谈判方式准入

解析：本题考查的是医保药品目录分类。根据《基本医疗保险用药管理暂行办法》和《2020年国家医保药品目录调整工作方案》，关于医保药品目录制定与调整的说法，正确的是医保目录调入分为常规准入和谈判准入两种方式，价格较高或者对医疗保险基金影响较大的专利独家应当通过谈判方式准入（A对）。医保目录调入分为常规准入和谈判准入两种方式。在满足有效性、安全性等前提下，价格（费用）与药品目录内现有品种相当或较低的，可以通过常规方式纳入目录；价格较高或对医保基金影响较大的专利独家药品应当通过谈判方式准入。国务院医疗保障行政部门建立完善医保药品目录动态调整机制，原则上每年调整一次（B错）。中药饮片采用专家评审方式进行调整，其他药品的调整程序主要包括企业申报、专家评审、谈判或准入竞价、公布结果（C错）。《基本医疗保险用药管理暂行办法》规定，从2020年9月1日起，预防性疫苗、保健药品、含国家珍贵、濒危野生动植物药材的药品等将不纳入《基本医疗保险药品目录》（D错）。